适宜痛风病人作为蛋白质来源的食物是
A. 主食、瘦猪肉
B. 鱼虾蟹
C. 鸡蛋、牛奶
D. 鸡蛋、海鱼
E. 淡水鱼

正确答案：C。鸡蛋、牛奶

解析：本题考查适宜痛风病人作为蛋白质来源的食物。痛风病人应限制蛋白质的摄入量从而控制嘌呤的摄取，可按每公斤体重0.8～1.0g计算，适宜选择牛奶、鸡蛋（C对ABDE错）及植物蛋白质。